死腔样通气是指
A. 部分肺泡血流不足
B. 部分肺泡通气不足
C. 部分肺泡通气不足而血流正常
D. 部分肺泡血流不足而通气正常
E. 生理死腔扩大

正确答案：D。部分肺泡血流不足而通气正常

解析：死腔样通气是指部分肺泡通气不足而血流正常（D对）。